患者，男性，45岁，干部。有高血压病史5年，一直用“卡托普利”降压治疗可控制。3个月前迁居新房后常出现咳嗽，以干咳为主，在医师建议下停用“卡托普利”药物，但仍咳嗽，先后多次行胸部X线检查未见肺实质性病变，查“血支原体阳性”而用“阿奇霉素”治疗后仍未见效而就诊，查体无阳性体征。为明确诊断首选的检查是
A. 血清支原体抗体
B. 结核菌素试验
C. 心脏彩超+心功能
D. 肺功能+激发试验
E. 胸部高分辨CT

正确答案：D。肺功能+激发试验